男，71岁，COPD患者。长期家庭氧疗，近10天因呼吸困难增加氧流量，1小时前被发现无法唤醒而就诊。查体：昏睡，球结膜充血水肿，双肺呼吸音低，双侧巴氏征阳性。动脉血气（鼻导管吸氧1.5升/分），pH7.18，PaO₂71mmHg，PaCO₂为76mmHg。该患者出现意识障碍最可能的原因是
A. 电解质紊乱
B. 脑梗死
C. 感染中毒性脑病
D. 二氧化碳潴留
E. 氧中毒

正确答案：D。二氧化碳潴留

解析：COPD患者因呼吸困难急性加重增加氧流量，致使患者吸入氧浓度过高引起二氧化碳潴留（D对），出现意识障碍，导致患者无法被唤醒，昏睡，球结膜水肿（二氧化碳潴留时可出现昏睡乃至昏迷、球结膜水肿的症状），双侧巴氏征阳性（巴氏征阳性常见于脑血管意外、脊髓横断性损伤等）。动脉血气结果pH7.18（pH正常范围：7.35～7.45），PaO₂71mmHg，PaCO₂76mmHg（PaCO₂〉50mmHg）提示酸中毒合并Ⅱ型呼吸衰竭。电解质紊乱（A错）临床表现不典型，但一般不会出现昏迷。脑梗死（B错）、感染中毒性脑病（C错）多见于2-10岁儿童，表现为高热、严重头痛、呕吐、烦躁不安和谵妄乃至昏迷，常有惊厥发作，与该患者表现不符。氧中毒（E错）只有在PaO₂低于30mmHg，才会出现神志丧失乃至昏迷。